下列关于显微血管的叙述中，不正确的说法是
A. 管径在5mm以内者必须借助显微镜进行手术
B. 显微微小血管为外径0.5～0.15mm
C. 显微细小血管为外径1～0.6mm
D. 显微小血管为外径3～1.1mm
E. 显微血管外科一般系指外径在2mm以下的血管外科手术而言

正确答案：A。管径在5mm以内者必须借助显微镜进行手术

解析：显微血管外科：一般系指外径在2mm以下的血管外科手术而言。血管外径在2mm以上者，可不用手术显微镜或放大镜下进行手术操作。管径在2mm以内者必须借助显微镜进行手术。显微血管一般分为三类：显微小血管（血管外径3～1.1mm）、显微细小血管（血管外径1～0.6mm）、显微微小血管（血管外径0.5～0.15mm）。掌握“口腔颌面部后天畸形概论”知识点。